下列各项，不属肝细胞性黄疸实验室检查结果的是
A. 总胆红素增高
B. 非结合胆红素增高
C. 结合胆红素增高
D. 尿胆原增高
E. 尿胆红素阴性

正确答案：E。尿胆红素阴性

解析：尿胆红素阴性为机体正常状态（E对）。总胆红素（STB）由结合胆红素（CB）非结合胆红素（UCB）组成。CB是指经肝脏处理且已与葡糖醛酸结合后形成的胆红素，呈水溶性，分子量小，能够通过肾脏排出（尿胆红素）；而UCB是指未经肝脏处理，未与葡糖醛酸结合的胆红素，呈脂溶性，分子量大，不能通过肾脏排出。任何原因使红细胞破坏增多、肝细胞功能受损及胆道阻塞，均可影响胆红素代谢过程。溶血性黄疸时，红细胞破坏过多，血中UCB增加，通过胆道进入肠道的胆红素增加，经细菌作用生成尿胆原、粪胆原增加。阻塞性黄疸时，肝中CB反流进入血中，因而进入肠道减少，尿胆原、粪胆原减少。肝细胞性黄疸时，肝脏代谢血中UCB能力下降以及肝细胞损害，血循环异常，CB反流入血，使血中CB和UCB均增加（ABC错）。尿胆红素阳性表明血CB增高。尿胆红素定性阳性提示肝细胞性黄疸和胆汁淤积性黄疸。肝细胞性黄疸时尿胆红素定性试验为阳性；胆汁淤积性黄疸时尿胆红素定性试验为强阳性；溶血性黄疸时尿胆红素定性试验为阴性。此外，碱中毒时由于胆红素分泌增加，尿胆红素定性试验也可呈阳性反应（D错）。